艾滋病病毒感染者和艾滋病病人应当履行的义务是
A. 接受疾病预防控制机构或者出入境检验检疫机构的流行病学调查和指导
B. 感染或者发病的事实及时告知与其有性关系者
C. 就医时，将感染或者发病的事实如实告知接诊医生
D. 采取必要的防护措施，防止感染他人
E. 以上都是

正确答案：E。以上都是

解析：为了保护社会和其他公民的健康权益，艾滋病病毒感染者和艾滋病病人应当履行下列义务：①接受疾病预防控制机构或者出入境检验检疫机构的流行病学调查和指导；②将感染或者发病的事实及时告知与其有性关系者；③就医时，将感染或者发病的事实如实告知接诊医生；④采取必要的防护措施，防止感染他人。艾滋病病毒感染者和艾滋病病人不得以任何方式故意传播艾滋病。掌握“艾滋病的预防与控制、治疗与法律责任”知识点。